缺铁性贫血患者代谢的特点是
A. 骨髓含铁血黄素增加
B. 血转铁蛋白降低
C. 血总铁结合力降低
D. 血清铁蛋白增加
E. 骨髓铁粒幼细胞减少

正确答案：E。骨髓铁粒幼细胞减少

解析：本题考查缺铁性贫血患者代谢的特点。缺铁性贫血患者代谢的特点是骨髓铁粒幼细胞减少（E对）。缺铁性贫血患者，骨髓含铁血黄素减低（A错），未结合的血转铁蛋白升高（B错），血总铁结合力升高（C错），血清铁蛋白降低（D错），骨髓铁粒幼细胞减少。